餐前服用，可以促进胃排空的药品是
A. 复方铝酸铋片
B. 二甲双胍片
C. 甲氧氯普胺片
D. 瑞舒伐他汀片
E. 维生素C

正确答案：C。甲氧氯普胺片

解析：本题考查药品服用的适宜时间。甲氧氯普胺（C对）为促胃动力药，餐前服用利于帮助消化，促进胃排空。复方铝酸铋（A错）为胃黏膜保护药，适宜于餐前服用。二甲双胍（B错）宜于餐中服用，可以减少对胃肠道的刺激和不良反应。瑞舒伐他汀（D错）宜在睡前服用，因为肝脏合成胆固醇峰期多在夜间，晚餐后服药有助于提高疗效。维生素C（E错）任何时间服用都可以。